下列英文缩写中“A”代表“管理局”的是
A. FDA
B. IPA
C. BA
D. CA
E. CPA

正确答案：A。FDA